患者，男，52岁，拔除左上第一磨牙腭侧断根，拔牙过程中发现其腭侧根消失，牙槽窝空虚，该患者最佳的处理方法是
A. 停止拔牙，拍X线片
B. 扩大牙槽窝取根
C. 行上颌窦开窗取根
D. 翻瓣去骨取根
E. 行口腔上颌窦瘘修补术

正确答案：A。停止拔牙，拍X线片

解析：本题考查拔牙术中并发症。患者，男，拔除左上第一磨牙腭侧断根，拔牙过程中发现其腭侧根消失，牙槽窝空虚，该患者最佳的处理方法是停止拔牙，拍X线片（A对）。如果牙周膜及骨硬板连续，则说明牙根没有位于上颌窦内，相反如果牙周膜及骨硬板没有连续性，就说明是牙根位于上颌窦内。病例中拔牙过程中发现其腭侧根消失，牙槽窝空虚，首要的第一步应该是先进行牙根定位，而扩大牙槽窝取根（B错）、行上颌窦开窗取根（C错）、翻瓣去骨取根（D错）、行口腔上颌窦瘘修补术（E错）都是后续步骤。